慢性龈缘炎的临床表现是
A. 牙周袋形成
B. 牙槽骨吸收
C. 牙松动
D. 牙移位
E. 探诊牙龈出血

正确答案：E。探诊牙龈出血

解析：本题考查慢性龈缘炎的临床表现。慢性龈炎临床表现有刷牙或咬硬物时牙龈出血；牙龈色、形、质的改变；龈沟深度一般不超过3mm及探诊牙龈出血（E对）和龈沟液量增多。牙周袋形成（A错），牙槽骨有吸收（B错），牙松动（C错）或牙移位（D错）均属于慢性牙周炎的临床表征。